某男，78岁。患多种慢性病，因腰腿疼痛、头晕失眠等不适症状就诊。医师开具中成药处方如下。执业药师审方时，发现该处方中多种中成药均含有乌头类药，可能加大患者发生不良反应的风险。该处方中含有乌头类药的中成药有
A. 乌灵胶囊
B. 金匮肾气丸
C. 养血安神片
D. 风湿骨痛胶囊
E. 松龄血脉康胶囊

正确答案：B、D。金匮肾气丸；风湿骨痛胶囊

解析：本题考查的是含乌头类药物的中成药。患多种慢性病，因腰腿疼痛、头晕失眠等不适症状就诊。医师开具中成药处方如下。执业药师审方时，发现该处方中多种中成药均含有乌头类药，可能加大患者发生不良反应的风险。该处方中含有乌头类药的中成药有金匮肾气丸（B对）与风湿骨痛胶囊（D对）。含乌头类药物的中成药：追风丸、追风透骨丸、三七伤药片、附子理中丸、金匮肾气丸、木瓜丸、小金丸、风湿骨痛胶囊、祛风止痛片、祛风舒筋丸、正天丸、右归丸等。养血安神片（C错）：【药物组成】熟地黄、首乌藤、墨旱莲、合欢皮、仙鹤草、地黄、鸡血藤。松龄血脉康胶囊（E错）：【药物组成】鲜松叶、葛根、珍珠层粉。乌灵胶囊（A错）的药物组成，2022年考试指南未明确说明。